上能清肺润喉，中能清胃生津，下能滋阴降火，治疗实热虚热均可选用的是
A. 芦根
B. 栀子
C. 知母
D. 石膏
E. 竹叶

正确答案：C。知母

解析：本题考查的是知母的性能特点。上能清肺润喉，中能清胃生津，下能滋阴降火，治疗实热虚热均可选用的是知母（C对）。知母：【性能特点】本品苦泄寒清，甘润滋滑，既入肺、胃经，又入肾与大肠经。但清降，不透散，并滋阴。上清肺热而泻火，中清胃热而除烦渴，下滋肾阴而润燥滑肠、退虚热。清热泻火虽不及石膏，但长于滋阴润燥，驱邪扶正两相兼。实火、虚热皆宜，高热或燥热津伤及阴虚发热者用之尤佳。芦根（A错）：【性能特点】本品甘寒质轻，清泄透利，入肺、胃经。既清肺胃之热而生津、除烦、止呕，又透肌表热邪而透解疹毒，还清利湿热而利尿。清利与透散并具，以清利为主，兼以透散，药力平和。不滋腻恋邪伤胃，味甘不苦易服。最宜治小儿肺热咳喘、风热感冒及防治小儿麻疹。清热不如石膏，生津不如知母，长于透散利水。栀子（B错）：【性能特点】本品苦寒降泄清利，入心、肺、三焦经。既清心肺三焦之火而泻火除烦解毒、凉血止血，又清利膀胱湿热与清泻滑利大肠，导湿热火毒外出，利小便、缓通便、退黄疸。捣烂外敷能散瘀血而消肿止痛。药力较缓，虽味苦而不燥湿，但能缓泻。既走气分，能清泻气分热；又走血分，能清泄血分热。清热泻火不如石膏，长于凉血解毒、退黄、止血、滑利二便。石膏（D错）：【性能特点】本品生用辛甘大寒，主清泄，兼透解，入肺、胃经，既善清泄气分实热和肺胃实火，又兼能解肌透热，热去则烦除、津生、渴止，为治气分高热和肺胃实火之要药。煅后涩凉，主收敛，兼清泄，外用能收敛生肌，兼清热，为治疮疡湿疹所常用。竹叶（E错）：【性能特点】本品甘寒清利，辛散轻扬，清利兼透，入心、肺经。既清心除烦、利尿，又凉散上焦风热。与淡竹叶相比，清心除烦力强，兼生津，热病心烦多用；又兼辛味，能凉散上焦风热，治风热表证及温病初期常用。其嫩心药力最强，善清心包之火，多用治温病热入心包之神昏谵语。